既病防变的基本原则是
A. 人工免疫
B. 早期诊治
C. 讲究卫生
D. 控制传变
E. 防止复发

正确答案：B、D。早期诊治；控制传变

解析：本题考查的是既病防变的基本原则。既病防变的基本原则是早期诊治（B对）与控制疾病的传变（D对）。既病防变，指在疾病发生之后，早期诊断，早期治疗，见微知著，防微杜渐，以防止疾病的发展和传变。既病防变的基本原则：1.早期诊治；2.控制疾病的传变。人工免疫（A错）与讲究卫生（C错）属于未病先防。未病先防的原则：未病先防，即是在疾病发生之前，做好各种预防工作，以防止疾病的发生。疾病的发生，关系到邪正两个方面的因素。邪气是导致疾病发生的重要条件，而正气不足是疾病发生的内在原因，外邪通过内因而起作用。因此，未病先防，包括以下两个方面的原则和方法。1.扶助正气，提高抗病能力：（1）重视精神调养。（2）加强身体锻炼。（3）注意生活起居。（4）人工免疫。2.消灭病邪，防止邪气侵害：（1）药物杀灭。（2）讲究卫生。（3）避免病邪侵害。（4）防范各种外伤。防止复发（E错）为愈后防复的目的。愈后防复，指在疾病初愈、缓解或痊愈时，要注意从整体上调理阴阳，维持并巩固阴阳平衡的状态，避免诱因，预防疾病复发，病情反复。1.调整阴阳平衡。2.避免复发诱因